红细胞血型物质的主要成分是
A. 蛋白质
B. 寡糖
C. 脂肪酸
D. 核酸
E. 小肽

正确答案：B。寡糖

解析：寡糖链中包含的生物信息可起识别作用，如红细胞的血型物质含糖达80%～90%。掌握“血液成分及血浆蛋白”知识点。